治疗新生儿黄疸湿热熏蒸证应选用
A. 茵陈术附汤
B. 茵陈蒿汤
C. 八正散
D. 清胃黄连丸
E. 参苓白术散

正确答案：B。茵陈蒿汤

解析：新生儿黄疸湿热熏蒸证是由于婴儿感受湿热邪毒，未能输化，郁结于里，熏蒸肝胆，胆汁外溢所致，治以清热利湿退黄，方药为茵陈蒿汤（B对）。茵陈术附汤（A错）其功用为温化寒湿，适用于阴黄之寒实阻遏证。八正散（C错）其功用为清热利湿通淋，适用于热淋。清胃黄连丸（D错）其功用为清胃泻火，解毒消肿，适用于肺胃火盛所致的口舌生疮，齿龈、咽喉肿痛等症。参苓白术散（E错）其功用为益气健脾、渗湿止泻，适用于脾虚夹湿证。